关于类风湿因子（RF）与类风湿关节炎（RA）的陈述正确的是
A. RF阳性的病人一定都是RA，而且RA病人RF—定都阳性
B. RF阳性的病人一定都是RA，但是RA病人RF不一定都阳性
C. RF阳性的病人不一定都是RA，但是RA病人RF—定都阳性
D. RF阳性的病人不一定都是RA，而且RA病人RF不一定都阳性
E. 在RA病人中，RF一旦出现就不再发生变化

正确答案：D。RF阳性的病人不一定都是RA，而且RA病人RF不一定都阳性

解析：RF（类风湿因子）可随疾病的变化而变化，其滴度一般与RA的活动性和严重性成正比，并非不可改变（E错）。RF与RA间并无特异性关系，RF不是诊断RA的必备条件，RF阴性者也不能排除RA的诊断。RF并非RA的特异性抗体，其他感染性、自身免疫性疾病及约5%的正常人也可以出现低滴度的RF（D对ABC错）。